属于时间依赖性且半衰期很短的抗菌药物是
A. 利奈唑胺
B. 莫西沙星
C. 阿奇霉素
D. 氟康唑
E. 氨苄西林

正确答案：E。氨苄西林

解析：本题考查时间依赖性抗菌药物。属于时间依赖性且半衰期很短的抗菌药物是氨苄西林（E对）。大多数抗生素后效应（PAE）或消除半衰期较短的β-内酰胺类、林可霉素、大部分大环内酯类药物属于时间依赖性抗菌药物。氨苄西林为β-内酰胺类，属于时间依赖性抗菌药物。氨基糖苷类、氟喹诺酮类、达托霉素、多黏菌素、硝基咪唑类等属于浓度依赖性抗菌药物。莫西沙星（B错）为氟喹诺酮类，属于浓度依赖性抗菌药物。时间依赖性且抗菌作用持续时间长，该类药物虽然为时间依赖性，但由于PAE或消除半衰期较长，使其抗菌作用持续时间延长。替加环素、利奈唑胺（A错）、阿奇霉素（C错）、四环素类、糖肽类等属于此类。